女，50岁。因患短肠综合症，予全胃肠外营养（TPN）治疗。应用一周时，病人出现昏迷，但尿内无酮体。病人既往曾有空腹血糖高（11mmol／L）。此病的发病机制是由于
A. 内源性胰岛素分泌不足
B. 等渗性脱水
C. 输液导管细菌滋生
D. 肝功能损害
E. 肾功能损害

正确答案：A。内源性胰岛素分泌不足

解析：若肠外营养液在配制时胰岛素比例过低且内源性胰岛素分泌不足（A对）时，同时肠外营养液输注速度过快时，即可出现高渗性非酮性昏迷。输液导管细菌滋生（C错）是导管感染败血症的发病机制。等渗性脱水（B错）、肝功能损害（D错）、肾功能损害（E错）与高渗性非酮性昏迷无关。